男性，42岁，10天前右大腿外伤，当时X线摄片无骨折，超声检查未见血肿，3天后右腿疼痛加重并有发热38.5℃，2天后体温上升到39℃，并伴有寒战，拟诊为右大腿深部脓肿，下列表现中，哪项不符合
A. 局部红肿不明显
B. 有全身症状
C. 局部压痛明显
D. 局部波动
E. 穿刺有脓

正确答案：D。局部波动

解析：深部脓肿局部有红肿，压痛明显，但是由于病变较深入，波动感不明显。掌握“外科感染”知识点。